中西药联用能减少西药用量和副作用的药组是
A. 桂枝汤与皮质激素类
B. 复方川贝精片和降压药
C. 防风通圣丸与解热镇痛药
D. 大黄清胃丸与喹诺酮类
E. 五味子糖浆与磺胺类

正确答案：A。桂枝汤与皮质激素类

解析：本题考查的是中西药联用的内容。中西药联用能减少西药用量和副作用的药组是桂枝汤与皮质激素类（A对）。桂枝汤、含人参的方剂与皮质激素类药联用，可减少激素的用量和副作用。复方川贝精片和降压药（B错）属于不合理联用。含麻黄碱的中药及其中成药，如复方川贝精片、莱阳梨止咳糖浆、复方枇杷糖浆等，不可与强心药、降压药联用。因麻黄碱会兴奋心肌β受体、加强心肌收缩力，与洋地黄、地高辛等联用时，可使强心药的作用增强，毒性增加，易致心律失常及心衰等毒性反应，同时麻黄碱也有兴奋α受体和收缩周围血管的作用，使降压药作用减弱，疗效降低，甚至使血压失去控制，可加重高血压患者的病情。防风通圣丸与解热镇痛药（C错）属于不合理用药。发汗解表药荆芥、麻黄、生姜等及其制剂（如防风通圣丸），与解热镇痛药阿司匹林、安乃近等合用，可致发汗太过，发生虚脱。五味子糖浆与磺胺类（E错）属于不合理联用。酸性较强的中药，如山楂、五味子、山茱萸、乌梅及中成药五味子糖浆、山楂冲剂等，不可与磺胺类药物联用。因磺胺类药物在酸性条件下不会加速乙酰化的形成，从而失去抗菌作用。大黄清胃丸与喹诺酮类（D错）的联用效果，2022年考试指南未明确说明。